新生儿雪口病的发生率是
A. 0.02
B. 0.03
C. 0.04
D. 0.05
E. 0.06

正确答案：C。0.04

解析：本题考查新生儿雪口病的发生率。新生儿雪口病的发生率为4%（C对）。新生儿雪口病是由念珠菌造成新生儿口腔的急性感染性炎症，多发生在出生后2～8天内，好发部位为颊、舌、软腭及唇。